紫杉醇（Taxol）是从美国西海岸的短叶红豆杉的树皮中提取得到的具有紫杉烯环结构的二萜类化合物，属有丝分裂抑制剂或纺锤体毒素。多西他赛（Docetaxel）是由10-去乙酰基浆果赤霉素进行半合成得到的紫杉烷类抗肿瘤药物，结构上与紫杉醇有点不同，一是第10位碳上的取代基，二是3′位上的侧链。多西他赛的水溶性比紫杉醇好，毒性较小，抗肿瘤谱更广。按药物来源分类，多西他赛属于
A. 天然药物
B. 半合成天然药物
C. 合成药物
D. 生物药物
E. 半合成抗生素

正确答案：B。半合成天然药物

解析：本题考查药物的来源。多西他赛属于半合成天然药物（B对）。以天然活性物质为原料通过化学半合成得到的药物为半合成天然药物。多西他赛是由10-去乙酰基浆果赤霉素进行半合成得到的又一个紫杉烷类抗肿瘤药物，所以为半合成天然药物。化学合成药物（C错）是指通过化学合成方法得到的小分子的有机或无机药物。来源于天然产物的药物是指从天然产物中提取得到的有效单体、通过发酵方法得到的抗生素以及半合成得到的天然药物和半合成抗生素。这些药物中，有些是直接从天然的植物提取得到的天然活性物质，为天然药物（A错）。但有很大一部分是以天然活性物质或抗生素为原料通过化学半合成或生物合成的方法得到的半合成天然药物或半合成抗生素（E错）。生物技术药物（D错）是指所有以生物物质为原料的各种生物活性物质以及人工合成类似物，以及通过现代生物技术制得的药物。